固有层密集淋巴细胞浸润带常见于
A. 扁平苔藓
B. 慢性盘状红斑狼疮
C. 口腔白斑
D. 寻常型天疱疮
E. 良性黏膜类天疱疮

正确答案：A。扁平苔藓

解析：本题考查扁平苔藓的病理变化。固有层密集淋巴细胞浸润带常见于扁平苔藓（A对）。扁平苔藓最具特征性的病理改变是基底细胞液化变性和淋巴细胞在紧邻上皮的固有层呈带状浸润。血管周围有淋巴细胞浸润常见于慢性盘状红斑狼疮（B错）。白斑（C错）上皮层的组织学表现可以为上皮单纯增生或异常增生；固有层可见不同程度的慢性炎症细胞浸润；少数情况下，棘层可表现为萎缩。寻常型天疱疮（D错）最具特征的病理表现是棘层松解和上皮内疱，固有层见轻度至中等程度的慢性炎症细胞浸润。良性黏膜类天疱疮（E错）形成上皮下疱，无棘层松解；早期见固有层有少量淋巴细胞浸润，以后炎症加重，可见多种炎症细胞密集浸润。